补骨脂的作用是
A. 摄涎止唾，温脾止泻
B. 摄涎止唾，固精缩尿
C. 温脾开胃，固精缩尿
D. 固精缩尿，暖肝和胃
E. 固精缩尿，温脾止泻

正确答案：E。固精缩尿，温脾止泻

解析：补骨脂为补阳药，性味辛苦、温，归肾、脾经，具有补肾壮阳，固精缩尿，纳气平喘，温脾止泻；外用消风祛斑之功（E对），常用来治疗脾肾阳虚所致的腰膝酸软、遗尿遗精、阳痿不孕、五更泄泻等症。将补骨脂研沫，用酒调和外用可治疗白癜风、斑秃。